咽腔异物滞留的部位是
A. 咽隐窝
B. 蝶筛隐窝
C. 扁桃体小窝
D. 梨状隐窝
E. 无

正确答案：D。梨状隐窝

解析：咽隐窝(A错)为鼻咽癌的好发部位，蝶筛隐窝(B错)位于上鼻甲后上方与蝶骨之间的间隙，扁桃体小窝(C错)易有细菌存留繁殖，成为感染病灶，梨状隐窝(D对)在喉口两侧，为异物容易滞留的部位。